胸导管注人
A. 左静脉角
B. 右静脉角
C. 乳糜池
D. 右颈干
E. 无

正确答案：A。左静脉角

解析：胸导管注入左静脉角（A对），右淋巴导管注入右静脉角（B错），乳糜池（C错）为胸导管起始，右颈干（D错）与右锁骨下干和右支气管纵隔干共同组成右淋巴导管。